编制寿命表时计算“0～”岁组死亡概率的分母为
A. 年初“0～”岁组人口数
B. 年中“0～”岁组人口数
C. 年末“0～”岁组人口数
D. 年内出生数
E. 年内活产数

正确答案：E。年内活产数

解析：本题考查寿命表编制。编制寿命表时计算“0～”岁组死亡概率的分母为年内活产数（E对ABCD错）。